患儿，6岁。发热3天，口腔内黏膜、齿龈溃烂，周围焮红，疼痛拒食，舌质红、苔薄黄。其诊断是
A. 感冒
B. 口糜
C. 心疳
D. 燕口疮
E. 鹅口疮

正确答案：B。口糜

解析：感冒以发热、恶寒、咳嗽、鼻塞、流涕为主症（A错）。题中患儿为小儿口疮的症状，若满口糜烂者，为口糜（B对）。心疳亦称口疳，为小儿疳证的兼证，除见口舌生疮，甚或满口糜烂，口气臭秽外，还伴有心火上炎的症状，如面赤心烦，夜寐不宁，小便短黄，吐舌，弄舌等（C错）。小儿口疮溃疡只发生在口唇两侧者，称为燕口疮（D错）。鹅口疮口腔及舌上满布白屑，周围有红晕，疼痛、流涎症状较轻，且多发于初生儿或体弱多病的婴幼儿（E错）。